青少年伤害一级预防的关键措施包括
A. 法律对策
B. 安全教育
C. 伤害监测
D. 社区康复
E. 主动和被动干预

正确答案：B。安全教育